男性，20岁。右下颌后牙出现肿痛、张口困难7天。检查见右下8斜位阻生，冠周组织稍红肿，张口度1cm，为了增加张口度以便拔除患牙，应采用
A. 下牙槽神经阻滞麻醉
B. 舌神经阻滞麻醉
C. 颊长神经阻滞麻醉
D. 咬肌神经阻滞麻醉
E. 颏神经、切牙神经阻滞麻醉

正确答案：D。咬肌神经阻滞麻醉

解析：本题考查咬肌神经阻滞麻醉。咬肌神经支配咬肌，咬肌收缩可使下颌向前上运动。由于智齿冠周炎侵犯咬肌，使咬肌痉挛，引起张口受限，为增大张口度，应咬肌神经阻滞麻醉（D对）。下牙槽神经阻滞麻醉（A错）区域有同侧下颌骨、下颌牙、牙周膜、前磨牙至中切牙唇（颊）侧牙龈、黏骨膜及下唇。舌神经阻滞麻醉（B错）区域有同侧下颌舌侧牙龈、黏骨膜，口底黏膜及舌前2/3部分。颊长神经阻滞麻醉（C错）区域有同侧下颌磨牙的颊侧牙龈、黏骨膜、颊部黏膜、肌和皮肤。颏神经、切牙神经阻滞麻醉（E错）区域有下颌第一前磨牙至切牙的唇（颊）侧牙龈、黏骨膜、牙髓、牙槽突和牙周膜。根据后面几组神经的麻醉区域来看，麻醉这些神经并不能改善咬肌痉挛，增大张口度。